主动安乐死与被动安乐死的区别在于
A. 前者是安乐死对象主动要求；后者是其被动要求
B. 前者是安乐死对象的家属主动要求，后者是其被动要求
C. 前者是负责医生主动要求；后者是其被动要求
D. 前者是医生采取促死手段使安乐死对象安然死去；后者是医生停止抢救甚至放弃一切治疗，任安乐死对象自然死去
E. 前者是安乐死对象自己采取促死手段致死；后者是其自己停止一切治疗，被动等死

正确答案：D。前者是医生采取促死手段使安乐死对象安然死去；后者是医生停止抢救甚至放弃一切治疗，任安乐死对象自然死去

解析：主动安乐死与被动安乐死的区别根据安乐死实施中“作为”与“不作为”将其分为主动（积极）安乐死和被动（消极）安乐死。前者是指对符合安乐死条件的病人，医生使用药物或其他方式尽快结束病人的痛苦生命，让其安宁、舒适地死去，对此目前争议较大；后者是指对符合安乐死条件的病人，医生停止使用抢救措施而仅给适当的维持治疗或者撤除所有的治疗和抢救措施，任其自然死去，这在医疗实践中早有实施。从以上可以看出，主动安乐死与被动安乐死是有区别的。掌握“安乐死与死亡伦理”知识点。